女，55岁，接触性阴道流血2个月。妇科检查：宫颈下唇可见菜花样肿物，大小2.5cm×2.0cm，阴道左后侧穹隆部可触及界限不清的质硬结节，宫颈活检回报鳞癌，该患者阴道部位病灶最可能是
A. 种植转移
B. 淋巴转移
C. 血行转移
D. 直接蔓延
E. 阴道原发

正确答案：D。直接蔓延

解析：患者中老年女性（子宫颈癌高发年龄），接触性阴道流血2个月。妇科检查：宫颈下唇可见菜花样肿物（提示为外生型浸润性鳞状细胞癌），阴道左后侧穹隆部可触及界限不清的质硬结节（累及阴道），宫颈活检回报鳞癌。据患者年龄、临床表现及检查，易诊断为宫颈鳞癌。直接蔓延累及阴道及其下壁是其最常见的转移途径（D对）。淋巴转移（B错）为癌灶侵入淋巴管，形成瘤栓，随淋巴液引流进入局部淋巴结。血行转移（C错）极少见，晚期可转移至肺、肝或骨骼等。